X线影像阻射性改变“橘皮”样型、毛玻璃型及硬化型为
A. 骨化纤维瘤
B. Garré骨髓炎
C. 成釉细胞瘤
D. 颌骨放射性骨坏死
E. Albright综合征

正确答案：E。Albright综合征

解析：本题考查Albright综合征。X线影像阻射性改变“橘皮”样型、毛玻璃型及硬化型为Albright综合征（E对）。Albright综合征X线表现可呈多样化，分为三大类：①透射性改变，又称囊样型。X线表现为单囊或多囊性密度减低病变，边界不很清楚，可有或无硬化边缘。②阻射性改变，包括“橘皮”样型、毛玻璃型及硬化型。病变密度高于正常且均匀一致，逐渐移行至正常骨。③透射及阻射混合性改变。除上述X线改变外，骨纤维异常增殖症尚有明显的沿颌骨外形膨大的特点。当病变累及牙周组织时，常使牙周骨硬板影像模糊或消失，但牙周膜间隙一般仍均匀存在。